直接标准化法选择的标准是
A. 各年龄组标准人口构成比或各年龄组标准化死亡率
B. 各年龄组标准人口构成比或各年龄组标准人口数
C. 各年龄组标准人口数或各年龄组标准死亡率
D. 各年龄组标准预期死亡人口数
E. 各年龄组标准分配死亡率

正确答案：B。各年龄组标准人口构成比或各年龄组标准人口数